环境质量评价中“评价”的英文单词是
A. assessment
B. evaluation
C. review
D. comment
E. appraise

正确答案：A。assessment

解析：本题考查环境质量评价中“评价”的英文单词。环境质量评价中“评价”的英文单词是“assessment”（A对BCDE错）。环境质量评价是从环境卫生学角度按照一定的评价标准和方法对一定区域范围内的环境质量进行客观的定性和定量调查分析、描述、评价和预测。